在进行大规模调查时，常把抽样过程分为几个阶段，每个阶段可采用单纯随机抽样的是
A. 单纯随机抽样
B. 系统抽样
C. 分层抽样
D. 整群抽样
E. 多级抽样

正确答案：E。多级抽样

解析：多级抽样：又称多阶段抽样。在进行大规模调查时，常把抽样过程分为几个阶段，每个阶段可采用单纯随机抽样。掌握“口腔健康状况调查的目的、项目、标准及方法”知识点。